下列哪项不是功能失调性子宫出血的主要表现
A. 月经周期紊乱
B. 经期延长
C. 出血量时多时少，甚至大量出血
D. 无规律的子宫出血
E. 生殖道器质性病变

正确答案：E。生殖道器质性病变

解析：本题考查功能失调性子宫出血的主要表现。生殖道器质性病变（E错，为本题正确答案）主要发生在女性不孕时期。功能失调性子宫出血的主要表现：月经周期紊乱（A对）、经期延长（B对）或提前、出血量时多时少，甚至大量出血（C对）的无规律的子宫出血（D对）。